能侵袭细菌的病毒是
A. 噬菌体
B. 毒性噬菌体
C. 温和噬菌体
D. 前噬菌体
E. 溶原性转换

正确答案：A。噬菌体

解析：噬菌体是侵袭微生物的病毒，只含有一种核酸DNA或RNA，可感染细菌、真菌、螺旋体和支原体等。掌握“噬菌体性状及分类”知识点。